吸入性颗粒物所产生的生物活性强弱取决于其
A. 溶解度
B. 挥发度
C. 解离度
D. 分散度
E. 光学异构

正确答案：D。分散度